根据藏药八性理论，水元偏盛的药物性能是
A. 热，锐
B. 凉，钝
C. 轻，糙
D. 柔，软
E. 重，腻

正确答案：B。凉，钝

解析：本题考查的是藏药八性理论。根据藏药八性理论，水元偏盛的药物性能是凉，钝（B对）。八性：重、腻、凉、钝、轻、糙、热、锐。八性源于五元，其中土元偏盛药物性能则重、腻（E错）；水元偏盛药物性能则凉、钝；火元偏盛药物性能则热、锐（A错）；风元偏盛药物性能则轻、糙（C错）。重、腻两性对治特性为轻、糙的隆病；凉、钝两性对治特性为热、锐的赤巴病；轻、糙、热、锐四性对治特性为重、柔、寒、钝的培根病。